氯丙嗪可引起口干、便秘、视力模糊等是由于
A. 阻断肾上腺素α受体
B. 阻断M胆碱受体
C. 阻断多巴胺（DA）受体
D. 阻断肾上腺素β受体
E. 阻断N胆碱受体

正确答案：B。阻断M胆碱受体

解析：氯丙嗪能阻断肾上腺素α受体和M胆碱受体。阻断α受体可致血管扩张、血压下降，但有较多副作用，故不适合于高血压的治疗；阻断M胆碱受体作用较弱，引起口干、便秘、视力模糊。掌握“氯丙嗪”知识点。